下列关于前列腺的说法中，何者错误
A. 呈栗子形
B. 下面邻尿生殖膈
C. 其内有尿道通过
D. 在老年人可能肥大
E. 正常时经肛门指诊不易触及

正确答案：E。正常时经肛门指诊不易触及

解析：前列腺形似栗子（A对）。下面邻尿生殖膈（B对）。其内有尿道通过（C对）。老年人易前列腺肥大（D对）。正常时经肛门指诊易（E错，为本题正确答案）触及。